DNA连接酶的催化作用在于
A. 解开超螺旋
B. 解开双螺旋
C. 合成引物RNA
D. 连接DNA链3'OH末端与另一DNA链的5'P末端
E. 连接DNA与RNA分子

正确答案：D。连接DNA链3'OH末端与另一DNA链的5'P末端